由于肝肠循环的存在，经胆汁排泄的砷被门静脉重吸收率为
A. 0.1
B. 0.2
C. 0.25
D. 0.3
E. 0.35

正确答案：B。0.2

解析：本题考查由于肝肠循环的存在，经胆汁排泄的砷被门静脉重吸收率。由于肝肠循环的存在，经胆汁排泄的砷被门静脉重吸收率为20%（B对ACDE错）。